被FDA批准用于治疗乙肝的细胞因子是
A. IFN-α
B. G-CSF
C. IFN-γ
D. TNF
E. IL-2

正确答案：A。IFN-α